下列几种传染过程中通常以哪一种为最多见
A. 隐性感染
B. 潜伏性感染
C. 显性感染
D. 病原携带状态
E. 病原体被消灭或被排出体外

正确答案：A。隐性感染